益智性状鉴别的主要特征是
A. 近球形，略具钝三棱
B. 卵圆形或椭圆形，密生短钝软刺
C. 纺锤形，表面有纵向断续棱线13-20条
D. 类球形，表面皱缩
E. 呈长卵形，表面具有6条翅状纵棱

正确答案：C。纺锤形，表面有纵向断续棱线13-20条